患子宫内膜癌最重要的危险因素为
A. 初次性交年龄过早
B. 多个性伴侣及性生活紊乱
C. 生育过早、过多、过密
D. 内源性或外源性雌激素
E. 病毒感染

正确答案：D。内源性或外源性雌激素